食品卫生检验单位
A. 使用的洗涤剂，消毒剂应当对人体安全、无害
B. 对生产经营者提供的技术资料有保密的义务
C. 进行食品卫生检验并出具检验报告
D. 封存造成食物中毒或者可能导致食品中毒的食品及其原料
E. 对发生食物中毒的患者采取抢救措施

正确答案：C。进行食品卫生检验并出具检验报告